毒性物质进入机体的方式主要是
A. 易化扩散
B. 扩散
C. 主动转运
D. 胞饮

正确答案：B。扩散

解析：本题考查毒性物质进入机体的方式。毒性物质进入机体的方式主要是扩散（B对ACD错）。